乳牙萌出顺序哪一个是正确的
A. ⅠⅡⅤ Ⅳ Ⅲ
B. ⅠⅡ ⅢⅤ Ⅳ
C. ⅠⅡ Ⅳ Ⅲ Ⅴ
D. ⅤⅠⅡ Ⅳ Ⅲ
E. ⅠⅡⅤⅢ Ⅳ

正确答案：C。ⅠⅡ Ⅳ Ⅲ Ⅴ

解析：乳牙萌出顺序：乳中切牙、乳侧切牙、第一乳磨牙、乳尖牙、第二乳磨牙。掌握“牙的萌出、更替及牙体解剖名词、标志”知识点。